构成传染病流行过程的必备因素有
A. 宿主，环境，病因
B. 传染源，传播途径，易感人群
C. 寄生虫，中间宿主，终末宿主
D. 社会因素，自然因素，遗传因素
E. 病原体及机体

正确答案：B。传染源，传播途径，易感人群

解析：构成传染病流行过程的必备因素有传染源、传播途径、易感人群（B对）。宿主是传染病发生的基本的条件之一，环境是影响传染病流行过程的因素，病因是传染病发生的原因（A错） 。病原体（如寄生虫）及宿主（即机体，如中间宿主、终末宿主）是传染病发生的两个最基本的条件（CE错） 。社会因素，自然因素（D错）是影响传染病流行过程的因素 。